治疗热毒蕴结，咽喉红肿疼痛，又兼肺热咳嗽，痰多者，应首选
A. 射干
B. 鱼腥草
C. 马勃
D. 板蓝根
E. 山豆根

正确答案：A。射干

解析：该题考查射干的功效，属记忆内容。热毒蕴结，咽喉红肿疼痛，兼有肺热咳嗽、痰多者治以清热解毒，消痰，利咽。射干味苦，性寒；入肺经；具有清热解毒，消痰，利咽的功效（A对）。鱼腥草具有清热解毒，消痈排脓，利尿通淋的功效，为治肺痈之要药（B错）。马勃具有清热解毒，利咽，止血的功效，为治疗咽喉肿痛的常用药（C错）。板蓝根具有清热解毒，凉血，利咽的功效，以解毒利咽散结见长，但没有消痰的功效（D错）。山豆根具有清热解毒，利咽消肿的功效，为治疗咽喉肿痛的的要药，但没有消痰的功效（E错）。